能够检测肺炎链球菌抗原的方法是
A. ELISA法
B. 补体结合试验
C. 免疫荧光实验
D. 中和试验
E. 试管凝集试验

正确答案：A。ELISA法

解析：临床上ELISA已广泛应用于细菌、病毒等多种病原体的微生物学诊断和流行病学调查。掌握“细菌学、血清学诊断及感染防治”知识点。